对毒作用带描述错误的是
A. 半数致死剂量与急性阈剂量的比值为急性毒作用带
B. 急性阈剂量与慢性阈剂量的比值为慢性毒作用带
C. 急性毒作用带值大，引起死亡的危险性大
D. 慢性毒作用带值大，发生慢性中毒的危险性大

正确答案：C。急性毒作用带值大，引起死亡的危险性大

解析：本题考查毒作用带的相关内容。毒作用带是表示化学物质毒作用特点的参数，又分为急性毒作用带与慢性毒作用带。急性毒作用带为半数致死剂量与急性阈剂量的比值（A对），急性毒作用带值小，说明化学物质从产生轻微损害到导致急性死亡的剂量范围窄，引起死亡的危险性大（C错，为本题正确答案）；反之，则说明引起急性中毒死亡的危险性小。慢性毒作用带为急性阈剂量与慢性阈剂量的比值（B对），慢性毒作用带值大，发生慢性中毒的危险性大（D对）；反之，则发生慢性中毒的危险性小。